沃辛瘤又称为
A. 混合瘤
B. 腺淋巴瘤
C. 圆柱瘤
D. Küttner瘤
E. 粉瘤

正确答案：B。腺淋巴瘤

解析：沃辛瘤又名腺淋巴瘤或乳头状淋巴囊腺瘤。A项为多形性腺瘤，C项为腺样囊性癌，D项为慢性硬化性下颌下腺炎，E项为皮脂腺囊肿。掌握“沃辛瘤”知识点。